皮疹高出皮肤，时现时隐，搔之连片，此为
A. 阳斑
B. 阴斑
C. 麻疹
D. 风疹
E. 瘾疹

正确答案：E。瘾疹

解析：瘾疹临床表现为皮肤上突然出现淡红色或淡白色丘疹，形状不一，小似麻粒，大如花瓣，皮肤瘙痒，搔之融合成片，出没迅速（E对）。斑有阳斑、阴斑之分。阳斑（A错）色多红紫，形似锦纹、云片，兼有身热烦躁、脉数等实热证表现。阴斑（B错）色多青紫，或淡红，隐隐稀少，兼有面白肢凉、脉虚等虚寒证表现。麻疹（C错）疹色桃红，形似麻粒，先见于发际颜面，渐渐延及躯干四肢，后按发起顺序逐渐消退。风疹（D错）疹色淡红，细小稀疏，皮肤瘙痒。